不同组织器官对化学毒物存在选择性毒性的原因有
A. 物种和细胞学差异
B. 不同生物及其细胞器官对化学毒物亲和力差异
C. 体内生物转化过程差异
D. 对化学毒物所致损害修复能力差异
E. 以上都是

正确答案：E。以上都是